对小肠的描述何者有误
A. 近端起于幽门
B. 远端与盲肠相接
C. 包括十二指肠、空肠和回肠
D. 十二指肠均属腹膜间位器官
E. 空、回肠均为腹膜内位器官

正确答案：D。十二指肠均属腹膜间位器官

解析：小肠近端起于幽门(A对)，远端与盲肠相接(A对)，包括十二指肠、空肠和回肠(C对)，十二指肠上部属腹膜内位器官，降部和水平部属腹膜外位器官(D错，为本题正确答案)，空、回肠均为腹膜内位器官(E对)。